一位妇产科病房的患者，手术后腹胀，哭闹着要找科主任给她看看。主任来后，经仔细查看，发现患者只是心理上有些问题，于是说了些安慰她的话，患者便安静下来了。有同事见了不以为然地说，这也值得主任来管？主任说：“难道当主任的就非得看什么大病吗？”“有些劳动是平凡的，好像毋须一顾，但是，它的精神是神圣的，一个人没有这种神圣的感觉，他就不会每件事都那么仔细、耐心地去作。”这充分体现了
A. 传统医学观、不伤害原则、同情美德
B. 现代医学观、不伤害原则、同情美德
C. 现代医学观、公正原则、正直美德
D. 传统医学观、公正原则、正直美德
E. 以上都不是

正确答案：C。现代医学观、公正原则、正直美德